不能在零售药店销售的药品是
A. 一类精神药
B. 二类精神药品
C. 试生产新药
D. 麻醉药品
E. 放射性药品

正确答案：A、C、D、E。一类精神药；试生产新药；麻醉药品；放射性药品

解析：本题考查药品零售。不能在零售药店销售的药品是一类精神药（A对）、试生产新药（C对）、麻醉药品（D对）、放射性药品（E对）。麻醉药品和第—类精神药品不得零售。批准为试生产的新药，仅供医疗单位在医生指导下使用，不得在零售药店出售。经营放射性药品必须是具备《放射性药品经营企业许可证》的药品经营企业，一般药品经营企业不能经营，不能零售。除经批准的药品零售连锁企业外，其他药品零售企业不得从事第二类精神药品（B错）零售活动。